手术中确认空肠起始的标志
A. 十二指肠球部
B. 十二指肠纵襞
C. 十二指肠水平部
D. 十二指肠升部
E. 十二指肠悬韧带

正确答案：E。十二指肠悬韧带

解析：十二指肠悬韧带(E对)为手术中确认空肠起始的重要标志。